症见不寐多梦，急躁易怒，可选用
A. 朱砂安神丸
B. 半夏厚朴汤
C. 龙胆泻肝汤
D. 归脾汤
E. 六味地黄丸

正确答案：C。龙胆泻肝汤

解析：本题考查的是不寐的辨证论治。症见不寐多梦，急躁易怒，可选用龙胆泻肝汤（C对）。不寐肝火扰心证：【症状】不寐多梦，甚则彻夜不眠，急躁易怒，伴头晕头胀，目赤耳鸣，口干而苦，不思饮食，便秘溲赤。舌红苔黄，脉弦而数。【方剂应用】基础方剂为龙胆泻肝汤（龙胆、泽泻、木通、车前子、当归、柴胡、生地黄、黄芩、栀子、生甘草）加减。朱砂安神丸（A错）为心悸阴虚火旺证的中成药应用。心悸阴虚火旺证：【症状】心悸易惊，心烦失眠，五心烦热，口干，盗汗，思虑劳心则症状加重，伴耳鸣腰酸，头晕目眩，急躁易怒。舌红少津，苔少或无，脉细数。【中成药应用】常用中成药有天王补心丸（水蜜丸）、朱砂安神片、宁神补心片、安神补心丸。半夏厚朴汤（B错）为郁证痰气郁结证的方剂应用。郁证痰气郁结证：【症状】精神抑郁，胸部闷塞，胁肋胀满，咽中如有物梗塞，咽之不下，咯之不出。舌苔白腻，脉弦滑。【方剂应用】基础方剂为半夏厚朴汤（半夏、厚朴、茯苓、生姜、苏叶）加减。归脾汤（D错）为不寐心脾两虚证的方剂应用。不寐心脾两虚证：【症状】不易入睡，多梦易醒，心悸健忘，神疲食少，伴头晕目眩，四肢倦怠，腹胀便溏，面色少华。舌淡苔薄，脉细无力。【方剂应用】基础方剂为归脾汤（人参、黄芪、白术、茯神、龙眼肉、酸枣仁、木香、当归、远志、甘草、生姜、大枣）加减。六味地黄丸（E错）为不寐心肾不交证的方剂应用。不寐心肾不交证：【症状】心烦不寐，入睡困难，心悸多梦，伴头晕耳鸣，腰膝酸软，潮热盗汗，五心烦热，咽干少津，男子遗精，女子月经不调。舌红少苔，脉细数。【方剂应用】基础方剂为六味地黄丸（熟地黄、山茱萸、山药、泽泻、茯苓、丹皮）合交泰丸（黄连、肉桂）加减。